属于环境中变应原的物质是
A. 多环芳烃
B. 一氧化碳
C. 炭粒
D. 花粉
E. 香烟烟雾

正确答案：D。花粉

解析：本题考查环境中变应原。花粉（D对ABCE错）是一种环境中变应原，它可以在空气中传播，并且可以被人类和动物吸入，从而引起过敏反应。